男，48岁，发作性胸痛一月，每次发作含硝酸甘油后缓解，考虑冠心病心绞痛。最有价值的检查方法是
A. 心脏X线摄片
B. 冠脉造影
C. 放射性核素检查
D. 动态心电图
E. 超声心动图

正确答案：B。冠脉造影

解析：患者中年男性，发作性胸痛一月，硝酸甘油可缓解，考虑冠心病心绞痛，，冠状动脉造影可以明确冠状动脉病变的严重程度，有助于诊断和决定进一步治疗（B对）。心脏X线摄片（A错）能显示出心脏大血管的大小、形态、位置和轮廓，不能评价心功能，对稳定型心绞痛并无特异的诊断意义。放射性核素检查（C错）可定量分析心肌灌注和心肌存活，但稳定型心绞痛尚未发展到心肌坏死。动态心电图（D错）用于检查非持续性心律失常，尤其是对一过性心律失常及短暂的心肌缺血发作，测量时间内患者不一定会有心绞痛的表现，不能准确捕捉心绞痛时的异常心电图。超声心电图（E错）是评价心脏收缩、舒张功能以及左心室充盈血流动力学的主要定量手段，但多数稳定型心绞痛患者静息时超声心动图检查无异常。